成熟红细胞所需能量来自
A. 糖的无氧酵解
B. 糖的有氧氧化
C. 磷酸戊糖途径
D. 乳酸生成反应
E. 2，3-二磷酸甘油酸支路

正确答案：A。糖的无氧酵解